用于耐青霉素的金黄色葡萄球菌引起的轻、中度感染或青霉素过敏者的药物是
A. 万古霉素
B. 克林霉素
C. 克拉霉素
D. 红霉素
E. 阿奇霉素

正确答案：D。红霉素

解析：本题考查红霉素。红霉素（D对）为大环内酯类抗菌药物，主要用于耐青霉素的金葡菌引起的轻、中度感染或青霉素过敏者。万古霉素（A错）用于耐金黄色葡萄球菌或对β-内酰胺类抗菌药物过敏的严重感染。克林霉素（B错）用于需氧革兰阳性球菌及厌氧菌。克拉霉素（C错）与奥美拉唑-替硝唑合用治疗幽门螺杆菌引起的胃溃疡。阿奇霉素（E错）用于化脓性链球菌引起的急性咽炎、急性扁桃体炎，敏感细菌引起的鼻窦炎、中耳炎。